新生儿是指从出生到多少天的婴儿
A. 30天
B. 28天
C. 60天
D. 7天
E. 100天

正确答案：B。28天

解析：本题考查新生儿的定义。新生儿是指从出生到28天（B对ACDE错）的婴儿，新生儿是宝宝出生后调节生理功能，适应宫外环境的重要时期。